生活性“三废”是指
A. 废水、废气、废渣
B. 污水、垃圾、粪便
C. 废水、垃圾、粪便
D. 废水、废渣、垃圾
E. 废气、废水、垃圾

正确答案：B。污水、垃圾、粪便

解析：本题考查生活性“三废”。生活性“三废”是指污水、垃圾、粪便（B对CDE错）。工业性“三废”是指废水、废气、废渣（A错）。